桑叶除疏散风热外，又能
A. 疏肝
B. 止痉
C. 升阳
D. 解毒
E. 清肺

正确答案：E。清肺

解析：本题考查桑叶的功效。桑叶除疏散风热外，又能清肺（E对）。桑叶【功效】疏散风热，清肺润燥，平肝明目，凉血止血。薄荷【功效】宣散风热，清利头目，利咽，透疹，疏肝（A错）。蝉蜕【功效】疏散风热，透疹止痒，明目退翳，息风止痉（B错）。葛根【功效】解肌退热，透疹，生津，升阳（C错）止泻。雄黄【功效】解毒（D错），杀虫，燥湿祛痰，截疟定惊。